慢性进行性头痛伴呕吐、视神经盘水肿提示
A. 脑血栓形成
B. 颅骨骨折
C. 偏头痛
D. 颅内占位性病变
E. 三叉神经痛

正确答案：D。颅内占位性病变

解析：头痛是指头颅内外各种性质的疼痛。慢性进行性头痛伴呕吐、视神经盘水肿提示存在颅内占位性病变（D对）如脑肿瘤等。脑血栓形成（A错）可出现头痛伴眩晕。颅骨骨折（B错）可出现头痛伴呕吐。偏头痛（C错）头痛可在呕吐后减轻。三叉神经痛（E错）可出现头痛伴神经功能紊乱。